患者，女，28岁，停经40天，妊娠试验结果阳性，平时月经周期32天。20天前因泌尿系统感染服用左氧氟沙星片3天，患者担心用药对胎儿有影响，前来咨询关于药物对胎儿影响的说法，正确的是
A. 此阶段是泌尿生殖器官发育期，其结果可能为胎儿泌尿生殖器官畸形
B. 此阶段胚胎细胞尚未分化，其结果可能为死胎流产或存活发育成正常胎儿
C. 此阶段是心脏发育期，其结果可能为胎儿心脏畸形
D. 此阶段是骨骼、肌肉发育期，其结果可能为胎儿骨骼发育异常
E. 此阶段是牙齿、中枢神经系统发育期，其结果可能为胎儿唇腭裂

正确答案：B。此阶段胚胎细胞尚未分化，其结果可能为死胎流产或存活发育成正常胎儿

解析：本题考查药物对妊娠期不同阶段胎儿的影响。此阶段胚胎细胞尚未分化，其结果可能为死胎流产或存活发育成正常胎儿（B对）。妊娠初始3个月，即妊娠12周末之前称为妊娠早期，妊娠早期：细胞增殖早期约为受精后18天左右，此阶段期间胚胎对药物无选择性表现，致畸作用无特异性地影响细胞，其结果为胚胎死亡、流产或存活而发育成正常个体。受精后3周至3个月是胚胎器官的分化时期，此期如受到药物影响可能产生形态或功能上的异常而造成畸形。